有长期咳嗽史病人，其心电图QRS额面平均电轴≥90度，重度顺时钟转位，Rv₁+Sv₅≥1.05mv，PⅡ＞0.22mv，最可能的诊断是
A. 阻塞性肺气肿
B. 支气管哮喘
C. 慢性肺源性心脏病
D. 风湿性心脏病二尖瓣狭窄
E. 心房间隔缺损

正确答案：C。慢性肺源性心脏病

解析：有长期咳嗽史的患者心电图QRS额面平均电轴≥90度，重度顺时钟转位，RV₁+SV₅≥1.05mV，PⅡ＞0.22mV等符合慢性肺源性心脏病的心电图表现，故最可能的诊断是慢性肺源性心脏病（C对）。而阻塞性肺气肿（P23）（A错）是以持续气流受限为特征的疾病，其辅助检查主要为肺功能检查，使用支气管扩张剂后，FEV₁/FVC＜0.70可确定为持续气流受限，故该患者不考虑此病。支气管哮喘（P28）（B错）是由多种细胞和细胞组分参与的气道慢性炎症性疾病，其辅助检查主要为肺功能检查以及肺部CT等，心电图无上述改变，故该患者不考虑此病。风湿性心脏病二尖瓣狭窄（P288）（D错）的心电图可见二尖瓣型P波（P波宽度大于0.12s，伴切迹），也可见到QRS电轴右偏和右心室肥厚表现，但晚期常合并房颤，故该患者不考虑此病。心房间隔缺损（P272）（E错）以劳力性呼吸困难为主要表现，可发生室上性心律失常，特别是房扑和房颤，不符合题干中的描述，故该患者不考虑此病。